男孩，4岁，站立不稳，不会喊“爸妈”，刚会走路，表情呆滞，眼外角上斜，鼻梁低平。身材矮小，四肢短，韧带松弛，四肢关节过度弯曲。如想确诊应该根据
A. 特殊面容
B. 贯通手
C. atd角的测定
D. 细胞遗传学诊断
E. 新生儿筛查

正确答案：D。细胞遗传学诊断